小面积烧伤，初期可用
A. 清凉油
B. 红油膏
C. 金黄膏
D. 冲和膏
E. 黄连膏

正确答案：A。清凉油

解析：清凉膏又叫清凉油乳剂，具有清热润肤的作用，用于烫伤初期，皮肤潮红，或有燎疱出水者（A对）。中期创面有感染者，用红油膏、黄连膏、生肌玉红膏外敷（BE错）。金黄膏，具有清热解毒、消肿止痛、散瘀化结的作用，适用于疮疡阳证（C错）。冲和膏，具有活血止痛、祛风散寒、消肿软坚的作用，适用于肿疡期半阴半阳证（D错）。